男，52岁，刚进屋时看见一人影，以为家人回来了，开灯一看是衣帽架，该现象是
A. 幻觉
B. 错觉
C. 妄想
D. 精神分裂
E. 躯体障碍

正确答案：B。错觉

解析：错觉是对客观事物歪曲的知觉（B对）。 幻觉是没有现实刺激作用于感觉器官时出现的知觉体验，是一种虚幻的知觉（A错）。思维内容障碍主要表现为妄想，它是在病态推理和判断基础上形成的一种病理性的歪曲的信念（C错）。精神分裂典型的症状是思维有障碍,患者常常觉得周围人看自己的眼光异样,会有被害忘想,思维和行动不一致,会出现情感的淡漠,意志活动减退等症状（D错）。躯体障碍是指患者对客观事物的整体属性能够正确感知，但对某些个别属性如大小、形状、颜色、距离、空间位置等产生错误的感知（E错）。